吸附薄层色谱法最常用的吸附剂是
A. 硅胶
B. 聚酰胺
C. 醋酸钠
D. 氢氧化钠
E. 十八烷基硅烷键合硅胶

正确答案：A。硅胶

解析：本题考查吸附薄层色谱法。吸附薄层色谱法的固定相为吸附剂，最常用的是硅胶（A对），其次有硅藻土、氧化铝、微晶纤维素等。